背侧丘脑是躯体感觉冲动的总汇点，通过它中继后再传到中央后回，请问右侧背侧丘脑损伤会出现
A. 左侧半身的本体感觉冲动不能上传
B. 左侧半身的痛温触压感觉冲动不能上传
C. 右侧半身的本体感觉冲动不能上传
D. 右侧半身的痛温触压感觉冲动不能上传
E. 左侧半身的本体感觉和痛温触压感觉冲动不能上传

正确答案：E。左侧半身的本体感觉和痛温触压感觉冲动不能上传

解析：右侧背侧丘脑中的腹后外侧核接受右侧内侧丘系、脊髓丘系的纤维，右侧内侧丘系传递左侧半身的本体感觉；右侧脊髓丘系传递左侧半身的痛温触压觉。因而右侧背侧丘脑损伤会出现左侧半身的本体感觉和痛温触压感觉冲动不能上传（E对）。